《赫尔辛基宣言》最初制定时间是
A. 1959年
B. 1962年
C. 1964年
D. 1988年
E. 2001年

正确答案：C。1964年

解析：最具影响力和普遍性的伦理文献是《赫尔辛基宣言涉及人的医学研究的伦理准则》（C对ABD错）。《国际性研究中的伦理与政策问题：发展中国家的临床试验》是在2001年（E错）。